某病人，13岁，在生活中养成不良的抽烟习惯，父母非常恼火，心理医生建议其采取的较有效的行为治疗是
A. 条件刺激和非条件刺激相结合
B. 环境因素和操作动作相结合
C. 厌恶刺激与不良行为相结合
D. 通过对不良行为的认识来矫正
E. 用转变注意力的方法来矫正

正确答案：C。厌恶刺激与不良行为相结合

解析：对烟酒以来患者，行为疗法的治理效果更持久且更易于接受。厌恶疗法是行为疗法的一种，通过轻微的惩罚来消除适应不良行为，主要适应症是露阴癖、恋物癖、酒精依赖、强迫症等。本例中13岁患者的抽烟习惯，属厌恶疗法的适应症（C对）。